适宜阴凉干燥的是
A. 荆芥
B. 白芍
C. 莱菔子
D. 熟地黄

正确答案：A。荆芥

解析：本题考查荆芥的贮藏养护。适宜阴凉干燥的是荆芥（A对）。荆芥【贮藏养护】置阴凉干燥处。白芍（B错）【贮藏养护】置通风干燥处。防蛀。莱菔子（C错）【贮藏养护】置通风干燥处，防蛀。熟地黄（D错）【贮藏养护】置阴凉通风干燥处。薏苡仁（E错）【贮藏养护】置通风干燥处，防蛀。